下列哪项不是职业病的特点
A. 控制接触后可消除和减少发病
B. 病因大多可以检测
C. 长期接触职业有害因素即可发病
D. 有群体发病性
E. 早期诊断、及时治疗、预后较好

正确答案：C。长期接触职业有害因素即可发病